具有清除血循环中免疫复合物功能的细胞是
A. 中性粒细胞
B. 红细胞
C. NK细胞
D. 巨噬细胞
E. 嗜碱性粒细胞

正确答案：D。巨噬细胞